不引起缺氧性肺血管收缩的体液因素是
A. 白三烯增加
B. 前列腺素F2a增加
C. 血栓素增加
D. 内皮素释放增加
E. 一氧化氮生成增加

正确答案：E。一氧化氮生成增加

解析：NO（E错，为本题正确答案）是血管内皮细胞生成和释放的舒血管物质，其发挥作用的可能机制是通过提高细胞中鸟苷酸环化酶的活性，使细胞内cGMP水平增高，降低胞质内游离Ca²⁺浓度（通过激活蛋白激酶使胞内Ca²⁺外流），使血管舒张。白三烯增加（A对）、前列腺素F2a增加（B对）、血栓素增加（C对）、内皮素释放增加（D对）均可在缺氧时引起肺血管的收缩。